粪隐血可能
A. 胃溃疡
B. 直肠癌
C. 白血病
D. 胆囊炎
E. 胰腺炎

正确答案：A、C。胃溃疡；白血病

解析：本题考查的是粪隐血的临床意义。粪隐血可能胃溃疡（A对）与白血病（C对）。粪隐血：消化道少量出血时，红细胞被消化而分解，肉眼及显微镜下均不能出现，故称为“隐血”（OB），必须用化学方式检测，称为隐血试验（OBT）。对于老年人粪隐血试验有助于早期发现消化道恶性肿瘤。临床意义：1.消化道溃疡：胃、十二指肠溃疡者的隐血阳性率可达40%～70%，可呈间歇性阳性。2.消化道肿瘤：胃癌、结肠癌者的隐血阳性率可达87%～95%，并呈持续性阳性。3.其他疾病：见于肠结核、克罗恩病、溃疡性结肠炎；全身性疾病如紫癜、急性白血病、伤寒、回归热、钩虫病等。直肠癌（B错）出现细条便。细条便为直肠狭窄的表现，主要见于直肠癌等。胆囊炎（D错）可见ALT、AST、GGT升高等。胰腺炎（E错）可见尿糖阳性、尿淀粉酶增高、ALT增高、AST升高、GGT升高、AMY活性增高或降低、病理性高血糖、糖耐量降低等。